下述哪个核团属内脏感觉核
A. 薄束核
B. 前庭神经核
C. 三叉神经中脑核
D. 楔束核
E. 孤束核

正确答案：E。孤束核

解析：孤束核（E对）属内脏感觉核，其上部（味觉核）为特殊内脏感觉核，接受经面神经、舌咽神经和迷走神经传入的味觉初级纤维；下部（心-呼吸核）为一般内脏感觉核，主要接受经舌咽神经和迷走神经传入的一般内脏感觉初级纤维。前庭神经核（B错）属特殊躯体感觉核，接受内耳球囊斑、椭圆囊斑和壶腹嵴的平衡觉冲动。三叉神经中脑核（C错）属一般躯体感觉核，接受咀嚼肌的本体感觉冲动。薄束核（A错）、楔束核（D错）不属于脑神经核团，属于躯干四肢本体感觉、精细触觉传导通路中的中继核团。